预防和控制性传播疾病及艾滋病不应
A. 倡导健康的性观念和安全的性行为
B. 得了性传播疾病之后羞于去医院就诊导致传染给别人
C. 采取适当的的形式，广泛宣传性病防治知识
D. 加强对性传播疾病的监测
E. 对性传播疾病高危人群进行有针对性的预防工作

正确答案：B。得了性传播疾病之后羞于去医院就诊导致传染给别人

解析：本题考查预防和控制性传播疾病及艾滋病的措施。预防和控制性传播疾病及艾滋病的措施主要包括：①倡导健康的性观念和安全的性行为（A对）；②采取适当的形式，广泛宣传性病防治知识（C对）；③加强对性传播疾病的监测（D对）；④对性传播疾病高危人群进行有针对性的预防工作（E对）。得了性传播疾病之后羞于去医院就诊导致传染给别人（B错，为本题正确答案）不属于预防和控制性传播疾病及艾滋病的措施。